碱性最弱的生物碱是
A. 季铵生物碱
B. 伯胺生物碱
C. 仲胺生物碱
D. 叔胺生物碱
E. 酰胺生物碱

正确答案：E。酰胺生物碱

解析：本题考查生物碱的理化性质。碱性最弱的生物碱是酰胺生物碱（E对）。通常情况下，根据生物碱的pKa，值大小，可将生物碱按碱性强弱分为：强碱（pKa>11），如季铵碱（A错）、胍类生物碱；中强碱（pKa7～11），如脂胺、脂杂环类生物碱；弱碱（pKa2～7），如芳香胺、六元芳氮杂环类生物碱；极弱碱（pKa<2），如酰胺、五元芳氮杂环类生物碱。